使用0.5%或1%利多卡因5ml作翼外肌封闭，1次/日，5～7次为一疗程治疗的疾病是
A. 翼外肌功能亢进
B. 翼外肌痉挛
C. 不可复性关节盘移位
D. 可复性关节盘移位
E. 肌筋膜痛

正确答案：A。翼外肌功能亢进

解析：翼外肌功能亢进的治疗方法：封闭治疗调整翼外肌功能。使用0.5%或1%利多卡因5ml作翼外肌封闭，1次/日，5～7次为一疗程。每次封闭的量和间隔时间可根据开口度、弹响情况来调整。掌握“颞下颌关节紊乱”知识点。